治疗流脑普通型首选的抗菌药物是
A. 青霉素
B. 磺胺药
C. 红霉素
D. 氨苄西林
E. 庆大霉素

正确答案：A。青霉素

解析：目前青霉素对脑膜炎球菌仍高度敏感，国内偶有耐药报道。青霉素不易透过血脑屏障，但加大剂量能在脑脊液中达到治疗有效浓度（A对）。成人剂量为 800万 U/d，每8小时一次。儿童剂量为20万～40万U/（kg·d），分3次加入5%萄糖液内静脉滴注，疗程5-7日。